女性，32岁。因旅途劳累而畏寒，高热，体温达39℃，干咳，右侧胸痛，深呼吸或咳嗽时加重。体检患者呈急性重病容，面部充血，口角有疱疹，右中下肺闻及支气管呼吸音，临床诊断急性肺炎。其最可能的病原体是
A. 肺炎支原体
B. 肺炎克雷伯杆菌
C. 肺炎链球菌
D. 肺炎衣原体
E. 金黄色葡萄球菌

正确答案：C。肺炎链球菌

解析：患者初步诊断为急性肺炎，由肺炎链球菌引起的细菌性肺炎的临床表现为：发病前常有受凉、淋雨、疲劳、病毒感染史，多有上呼吸道感染的前驱症状。起病急骤，高热、寒战，全身肌肉酸痛，体温在数小时内升至39～40℃；体征有：急性面容，面颊绯红，鼻翼煽动，口角及鼻周有单纯疱疹；肺实变时叩诊浊音，触觉语颤增强并可闻及支气管呼吸音。患者的临床表现符合肺炎链球菌性肺炎，故引起此病最可能的病原体为肺炎硫球菌。掌握“肺炎”知识点。